药物利用研究中，限定日计量方法的局限性原理为
A. 大样本研究中依从性不易保证
B. 不同区域人群用药情况不尽相同
C. 仅考虑主要适应症的用药剂量
D. 不适用于儿童群体的药物利用研究
E. 仅适用于儿童群体的药物利用研究

正确答案：A、B、C、D。大样本研究中依从性不易保证；不同区域人群用药情况不尽相同；仅考虑主要适应症的用药剂量；不适用于儿童群体的药物利用研究

解析：本题考查限定日计量方法的局限性。DDD方法的局限性：（1）大样本的研究中，患者依从性不易保证（A对），可能造成结果的不准确。（2）不同区域的人群用药情况不尽相同（B对），即DDD值可能会存在差异。（3）不适用于儿童的药物利用研究（D对E错），如未能将儿童用药从总量中剔除，会造成用药人数预测结果偏低。（4）只考虑主要适应证的用药剂量（C对），当病程不同时期的用药剂量变异大，或合并用药时要对药物剂量进行增减，再或一种药物有多种适应证（如阿司匹林）时，使用DDD法受限，如上述情况混入样本中，会对研究结果造成偏差。